穿过收肌管的神经
A. 闭孔神经
B. 股神经
C. 生殖股神经
D. 胫神经
E. 隐神经

正确答案：E。隐神经

解析：隐神经（E对）伴随股动脉进入收肌管下行，出此管后在膝关节内侧继续下行，于缝匠肌下端的后方浅出至皮下。